肩周炎的临床特点为
A. 活动时疼痛、功能受限
B. 静息时疼痛、功能受限
C. 活动时疼痛、功能无受限
D. 静息时无痛、功能受限
E. 活动时无痛、功能受限

正确答案：A。活动时疼痛、功能受限

解析：肩周炎是肩周肌肉、肌腱、滑囊及关节囊的慢性损伤性炎症，以活动时疼痛、功能受限为主要特点（A对），且疼痛随病程的延长和活动范围的增大而加剧。静息时疼痛、功能受限（B错）见于强直性脊柱炎。